某山区，将废弃农药当作垃圾倾倒在附近中学的水井旁，若干时期后，不少学生与教职工中陆续出现四肢对称性感觉、运动障碍，皮肤色素异常，有的还有色素缺失，呈点状、片状白色斑点（块），更有少数人出现皮肤角化（手掌、脚跖部更甚）等症状。经上级疾控中心检测井水中砷含量为0.20mg/L，初步诊断为砷中毒，但为了进一步确定这一事件的原因与病症，最应检测的项目是
A. 进一步进行卫生调查
B. 调查村民的生活方式
C. 核查井水中砷含量
D. 检测食品中含砷量
E. 病人的生物测量

正确答案：E。病人的生物测量

解析：本题考查诊断砷中毒应检测的项目。砷中毒是一种慢性毒性疾病，它是由于长期接触砷而引起的，可能会导致肝脏、肾脏、神经系统、血液系统等组织器官的损害，以及皮肤病变、视力下降、记忆力减退等症状。因此，为了进一步确定这一事件的原因与病症，最应检测的项目是病人的生物测量（E对ABCD错），以便更准确地诊断砷中毒。